女，45岁。腹泻10年。精神紧张时加剧，排便前腹痛，排便后腹痛可缓解。大便为糊状，发病以来体重无明显变化。既往体健，平素进食好，睡眠差。查体：T36.5℃，P80次／分，R18次／分，BP120/80mmHg。未见皮疹，双肺呼吸音清，闻及干湿性啰音，心律齐。腹软，无压痛。为明确检查，首选的检查是
A. 结肠镜
B. 全消化道X线钡餐造影
C. 腹部CT
D. 腹部血管造影
E. 小肠镜

正确答案：A。结肠镜

解析：女性患者，腹泻10年。精神紧张加剧（和精神因素有关），排便后缓解且大便性状为糊状（无粘液脓血便），体检无异常，仅有腹痛和排便异常可考虑肠易激综合征。对于该病要排除器质性疾病，首选的检查是结肠镜（A对）或钡剂灌肠（二版八年制内科学P476）而不是全消化道X线钡餐造影（B错）；腹部CT（C错）可诊断器质性病变但是价格高，且没有结肠镜直观不作为首选；腹部血管造影（D错）可用于鉴别肠系膜血栓栓塞不作为首选；小肠镜（E错）为全小肠无盲区检查，而肠易激综合征发生在结直肠，小肠镜作为鉴别诊断操作不作为首选。